烯丙吗啡用于解救
A. 水银中毒
B. 有机磷中毒
C. 硫酸铜中毒
D. 氰化物中毒
E. 吗啡中毒

正确答案：E。吗啡中毒

解析：本题考查中毒解救。烯丙吗啡用于解救吗啡中毒（E对）。吗啡中毒可用纳洛酮和烯丙吗啡等解救。水银中毒（A错）可用二巯丙醇、二巯丙磺钠、青霉胺和二巯丁二钠等解救。有机磷中毒（B错）可用阿托品、碘解磷定、氯解磷定等解救。硫酸铜中毒（C错）可用依地酸钠等解救。氰化物中毒（D错）可用亚硝酸异戊酯、亚硝酸钠+硫代硫酸钠、亚甲蓝等解救。